痛风者急性关节炎期常见单个关节出现红肿、热痛、最常见的部位是
A. 趾关节
B. 颈椎关节
C. 胸椎关节
D. 腰椎关节
E. 膝关节

正确答案：A。趾关节

解析：本题考查痛风。急性痛风性关节炎最常见的发作部位为第一跖趾关节（A对），其次为踝、足跟、腕、指关节等。颈椎关节（B错）、胸椎关节（C错）、腰椎关节（D错）、膝关节（E错）不符合题意。